全冠粘固后出现龈缘炎，其可能的原因，除了
A. 轴壁突度不良
B. 冠边缘过长
C. 冠边缘不密合
D. 龈沟内粘固剂残留
E. 咬合早接触

正确答案：E。咬合早接触

解析：本题考查全冠粘固后出现龈缘炎的原因。全冠存在咬合早接触（E错，为本题的正确答案）时，会造成（牙合）创伤，而单纯的（牙合）创伤只引起牙槽骨、牙周膜和牙骨质的变化，并不影响牙周组织，不会引起龈缘炎。修复体轴壁突度不良（A对）时，如轴壁突度不足，食物冲击牙龈，易造成龈缘炎；轴壁突度过大，食物向龈方滑动时，使龈组织失去生理按摩作用，也可造成局部龈缘炎。冠边缘过长（B对）时，会直接刺激牙龈，造成牙龈炎。修复体密和度（C对）和龈炎的产生有密切关系，在修复体边缘止于龈下或平齐者，不密合的修复体龈边缘本身就是产生龈缘炎的直接刺激因素，而不密合的边缘往往形态不良，容易聚积食物碎渣，不易自洁与洗刷；当修复体边缘置于龈下时，边缘处更容易聚积菌斑，引起龈缘炎。龈沟内粘固剂残留（D对）时，残留的粘固剂不仅会直接刺激牙龈，形成龈缘炎；同样影响食物从龈沟排溢，致使菌斑聚积，导致龈缘炎。